用于鉴别疱疹样口疮与疱疹性口炎的重要的一项是
A. 预后好坏
B. 病损大小
C. 疼痛程度
D. 有无皮损
E. 针刺反应

正确答案：D。有无皮损

解析：本题考查疱疹样口疮与疱疹性口炎的鉴别。疱疹性口炎好发于婴幼儿，急性发作，全身症状较重，成簇的小水疱，破溃后成为大片的浅表溃疡，损害遍及口腔黏膜各处包括牙龈、上腭、舌、颊和唇黏膜，可伴皮肤损害；疱疹样口疮好发于成人，反复发作，全身反应较轻，为散在的小溃疡，无发疱期，损害仅限于口腔非角化黏膜，无皮肤损害，两者可通过有无皮肤损害鉴别（D对）。预后的好坏（A错）、病损大小（B错）以及疼痛程度（C错）不能用于鉴别疱疹样口疮与疱疹性口炎。针刺反应（E错）为白塞病的特征性表现，不能鉴别疱疹样口疮与疱疹性口炎。